患者，女，48岁。停经7个月，阴道流血3天，自觉烘热汗出，头晕耳鸣，心悸失眠，焦虑，烦躁，盆腔检查未见异常。首先应考虑的诊断是
A. 经断复来
B. 月经不调
C. 绝经综合征
D. 崩漏
E. 绝经过渡期功血

正确答案：C。绝经综合征

解析：根据本题患者年龄48岁，在绝经的同时出现阴道流血、血管舒缩症状、精神神经症状，可诊断为绝经综合征（C对）；经断复来又称为年老经水复行，是指绝经期妇女月经停止1年或1年以上，又再次出现子宫流血，可伴有乳房胀痛，下腹部坠胀，头晕眼花等症状（A错）；月经不调临床表现为月经周期或出血量紊乱，可伴经前、经时腹痛（B错）；崩漏是指妇女不在行经期，阴道大量出血，或持续下血淋漓不断，又称"崩中漏下"（D错）；绝经过渡期功血指发生在绝经过渡期，而出现的异常子宫出血，主要表现为月经过多、月经周期紊乱、子宫不规则过多出血等（E错）。